固位体按其作用不同可分为
A. 简单固位体和复杂固位体
B. 直接固位体和间接固位体
C. 单一固位体和多样固位体
D. 一次固位体和二次固位体
E. 固定固位体和活动固位体

正确答案：B。直接固位体和间接固位体

解析：本题考查局部义齿人工牙及基托。固位体的种类：按其作用不同可分为直接固位体和间接固位体（B对）两种。